在水中不发生解离的非离子表面活性剂是
A. 硬脂酸钠
B. 苯扎溴铵
C. 卵磷脂
D. 聚乙烯醇
E. 聚山梨酯80

正确答案：E。聚山梨酯80

解析：本题考查非离子型表面活性剂。聚山梨酯80（E对）是一种在水中不发生解离的非离子表面活性剂；硬脂酸钠（A错）为阴离子表面活性剂；苯扎溴铵（B错）为阳离子表面活性剂；卵磷脂（C错）为两性离子表面活性剂；聚乙烯醇（D错）为高分子表面活性剂。